回阳救急汤除回阳救急外，还具有的功用是
A. 益气养阴
B. 养血通脉
C. 益气生脉
D. 活血止痛
E. 养血敛阴

正确答案：C。益气生脉

解析：本题考查回阳救急汤的功用，属记忆内容。回阳救急汤功用回阳固脱，益气生脉”（C对）。本方治疗寒邪直中三阴，真阳衰微，无养阴之功（A错）。本方是回阳通脉而无养血之功（BD错）。本方无淤血之症状不需活血止痛（C错）。